患者因上前牙有洞要求治疗。查：左右上1近中面龋，墨浸状边缘嵴未破坏，冷测同对照牙，诊断为中龋。治疗时去腐达牙本质浅层。该牙一次治疗完成可选择
A. 玻璃离子水门汀垫底，光敏树脂充填
B. 光敏树脂充填
C. 玻璃离子水门汀充填
D. 磷酸锌水门汀垫底，光敏树脂充填
E. 氧化锌丁香油糊剂垫底，光敏树脂充填

正确答案：A。玻璃离子水门汀垫底，光敏树脂充填

解析：本题考查中龋的治疗。患者因上前牙有洞要求治疗。查：左右上1近中面龋，墨浸状边缘嵴未破坏，冷测同对照牙，诊断为中龋。治疗时去腐达牙本质浅层。该牙一次治疗完成可选择玻璃离子水门汀垫底，光敏树脂充填（A对）。患牙为前牙中龋，为保证美观，应选用光敏树脂进行充填治疗；中龋应先垫底，以隔绝外界刺激，玻璃子对牙髓的刺激小，生物相容性好，可释放氟，有防龋作用，故该牙一次充填治疗应选择玻璃离子水门汀垫底，光敏树脂充填（A对B错）。玻璃离子水门汀强度较低，不耐磨，一般不用于恒牙的直接充填（C错）。磷酸锌会释放游离酸，刺激牙髓（D错）。丁香酚可影响树脂聚合，复合树脂充填时不能用氧化锌丁香油粘固剂垫底（E错）。